流行病学工作深度的三个范畴是
A. 设计、测量、评价
B. 描述性流行病学、分析性流行病学、实验流行病学
C. 观察法、实验法、数理法
D. 传染病、非传染病、伤害
E. 提示现象，找出原因，提供措施

正确答案：B。描述性流行病学、分析性流行病学、实验流行病学